患者，女，30岁。患有系统性红斑狼疮，长期大量服用糖皮质激素治疗。最可能出现的不良反应是
A. 血糖降低
B. 血压降低
C. 红细胞数减少
D. 淋巴细胞增多
E. 体内脂肪重新分布

正确答案：E。体内脂肪重新分布

解析：对于系统性红斑狼疮的治疗，糖皮质激素是首选药，水、盐、糖、蛋白质及脂肪代谢紊乱是其常见的不良反应，其中最常见的为引起体内脂肪重新分布（E对），患者表现为向心型肥胖、满月脸（ABCD错）。